男，30岁。排便次数增多、大便带血1个月。无腹痛、发热，无体重变化。查体：T36.5℃，P80次/分，R18次/分，BP120/80mmHg。浅表淋巴结未触及。双肺呼吸音清，未闻及干湿性啰音，心律齐。腹软，无压痛，肝脾肋下未触及。直肠指检：触及一个柔软光滑有蒂包块，直径约1cm，指套带血。最可能诊断是
A. 结肠癌
B. 直肠息肉
C. 血栓性外痔
D. 肛窦炎
E. 直肠癌

正确答案：B。直肠息肉

解析：患者排便次数增多、大便带血，直肠指检：触及一个柔软光滑有蒂包块，直径约1cm，指套带血。最可能诊断是直肠息肉（B对）。无腹痛、发热，无体重变化，浅表淋巴结未触及，腹软，无压痛，肝脾肋下未触及，提示良性病变。结肠癌（A错）可出现贫血、消瘦、乏力、低热。血栓性外痔（C错）肛周暗紫色卵圆形肿物，表面皮肤水肿、质硬、急性期触痛压痛明显（P405）。直肠癌（E错）扪及高低不平的硬结、溃疡、菜花状肿物，肠腔可有狭窄，指套上常有脓血和黏液（P384）。